饮食五味偏嗜，引起“皮槁而毛拔”的原因是
A. 多食咸
B. 多食苦
C. 多食酸
D. 多食甘
E. 多食辛

正确答案：B。多食苦

解析：本题《素问·五藏生成》说：“多食咸（A错），则脉凝泣而变色；多食苦（B对），则皮槁而毛拔；多食辛（E错），则筋急而爪枯；多食酸（C错），则肉胝皱而唇揭；多食甘（D错），则骨痛而发落”。五味偏嗜，脏气偏盛，导致“伤己所胜”的病理变化。